绝脉的临床意义是
A. 邪盛正衰
B. 气血大虚，阳气衰微
C. 病邪深重，元气衰竭
D. 元气离散
E. 痰饮食滞

正确答案：C。病邪深重，元气衰竭

解析：真脏脉又称绝脉，是由于无胃气而真脏之气外泄的脉象，其特点是无胃、无神、无根。真脏脉的出现，绝大部分表示病邪深重，元气衰竭（C对），胃气已败，是病情极度危重，濒临死亡的征象。散脉主病元气离散 （D错）。